具有生津止渴功效的药物是
A. 生地
B. 牡丹皮
C. 赤芍
D. 紫草
E. 金银花

正确答案：A。生地

解析：生地甘寒质润，功能清热养阴生津，治热病伤阴，烦渴多饮及阴虚内热之消渴（A对）。牡丹皮（B错）的功效是清热凉血，活血化瘀。赤芍（C错）的功效是清热凉血，散瘀止痛。紫草（D错）的功效是清热凉血，活血解毒，透疹消斑。金银花（E错）的功效是清热解毒，疏散风热。